抢救刺激性气体中毒时最关键的措施是
A. 改善缺氧
B. 应用解毒剂
C. 给予镇静剂
D. 防止中毒性肺水肿
E. 对症处理

正确答案：D。防止中毒性肺水肿